间接固位体为防止义齿
A. 翘起
B. 摆动
C. 旋转
D. 下沉
E. 以上说法均正确

正确答案：E。以上说法均正确

解析：间接固位体：防止义齿翘起、摆动、旋转、下沉的固位体，称为间接固位体。间接固位体具有辅助直接固位体固位和增强义齿稳定的作用。掌握“局部义齿人工牙及基托”知识点。